嵌顿性疝与绞窄性疝的区别是
A. 疝囊有无压痛
B. 疝内容物能不能回纳
C. 疝内容物有无血运障碍
D. 是否有休克
E. 是否有机械性肠梗阻的表现

正确答案：C。疝内容物有无血运障碍

解析：嵌顿性疝发展到肠壁动脉血流障碍阶段，即为绞窄性疝，所以嵌顿性疝与绞窄性疝的区别是疝内容物有无血运障碍（C对）。